下列何种药具有抑制胃酸分泌的功能
A. 碳酸钙
B. 三硅酸镁
C. 氢氧化铝
D. 西咪替丁
E. 氢氧化镁

正确答案：D。西咪替丁

解析：西咪替丁（D对）属于H₂受体阻断药，能够选择性阻断胃壁细胞H₂受体，拮抗组胺引起的胃酸分泌，不仅能够抑制基础胃酸的分泌，对促胃液素、食物、咖啡因、刺激迷走神经等引起的胃酸分泌也有抑制作用。碳酸钙（A错）、三硅酸镁（B错）、氢氧化铝（C错）、氢氧化镁（E错）均为无机弱碱，为常用的抗酸药，口服后能够中和胃酸，抑制胃蛋白酶活性，降低或消除胃酸、胃蛋白酶对胃、十二指肠黏膜的侵蚀和对溃疡面的刺激，缓解疼痛和促进溃疡面愈合，无抑制胃酸分泌的作用。